某女40岁，月经漏下不止，经血色暗伴有血块已有2月，时见乏力倦怠，舌边尖有瘀点，脉涩，对其应采用的治则是
A. 祛邪
B. 扶正
C. 先祛邪后扶正
D. 先扶正后祛邪
E. 扶正与祛邪兼用

正确答案：C。先祛邪后扶正

解析：本题考查的是扶正祛邪的运用。某女40岁，月经漏下不止，经血色暗伴有血块已有2月，时见乏力倦怠，舌边尖有瘀点，脉涩，对其应采用的治则是先祛邪后扶正（C对）。扶正祛邪的运用：运用扶正祛邪治则时，要认真细致地观察和分析正邪两方消长盛衰的情况，并根据正邪在矛盾斗争中的地位，决定扶正与祛邪的主次和先后。1.扶正（B错）：扶正适用于以正气虚为主要矛盾，而邪气也不盛的虚性病证。如补法，包括补气、助阳、滋阴、养血等，为扶正治则指导下的具体治法。2.祛邪（A错）：祛邪适用于以邪实为主要矛盾，而正气未衰的实性病证。如汗法、吐法、下法、清法、消法等，皆属祛邪治则指导下的具体治法。3.扶正与祛邪兼用（E错）：扶正与祛邪兼用又称“攻补兼施”，适用于正虚邪实病证，两者同时兼用，则扶正不留邪，祛邪又不会伤正。在具体应用时，还要分清以正虚为主，还是以邪实为主。正虚较急重的，应以扶正为主，兼顾祛邪；而邪实较急重的，则以祛邪为主，兼顾扶正。4.先祛邪后扶正：先祛邪后扶正适用于虽为邪盛正虚，但正气尚能耐攻，或同时兼顾扶正反会助邪的病证。如瘀血所致的崩漏证，瘀血不去，则崩漏难止，故应先用活血祛瘀法，然后补血。5.先扶正后祛邪（D错）：先扶正后祛邪适用正虚邪实，以正虚为主的病证。因正气过于虚弱，若兼以攻邪，则反而更伤正气，故应先扶正而后祛邪。如某些虫积患者，因正气太虚弱，不宜驱虫，应先健脾以扶正，使正气得到一定恢复之时，然后再驱虫消积。